下列关于吗啡的说法，错误的是
A. 具有多氢菲环结构的生物碱，常制成盐类供临床使用
B. 3位酚羟基甲基化得到可待因，具有镇咳作用
C. 是两性化合物，3位的酚羟基显弱酸性，17位的N-甲基叔胺显弱碱性
D. 3位酚羟基在体内与葡萄糖醛酸结合，口服生物利用度高
E. 在酸性溶液中加热会生成阿扑吗啡，具有催吐作用

正确答案：D。3位酚羟基在体内与葡萄糖醛酸结合，口服生物利用度高

解析：本题考查吗啡的结构与临床使用。吗啡口服肝首关效应大，生物利用度低（D错，为本题正确答案），一般制成注射剂或缓释片。